非医疗性质反复使用麻醉药品属于
A. 身体依赖性
B. 药物敏化现象
C. 药物滥用
D. 药物耐受性
E. 抗药性

正确答案：C。药物滥用

解析：本题考查药物滥用与药物依赖性。非医疗性质反复使用麻醉药品属于药物滥用（C对）。药物滥用是指非医疗目的地使用具有致依赖性潜能的精神活性物质的行为。身体依赖性（A错）是指中枢神经系统对长期使用的药物所产生的一种身体适应状态；一旦停药，将发生一系列生理功能紊乱，称为戒断综合征。药物敏化现象（B错）是药物使另一药物对其作用部位的亲和力和敏感性增强的现象。药物耐受性（D错）是指在连续用药过程中，有的药物的药效会逐渐减弱，需加大剂量才能显效的现象。抗药性（E错）又称耐药性，系指在化学治疗中，病原体或肿瘤细胞对化疗药物的敏感性降低的现象。